女，35岁，因左下后牙对冷热刺激敏感1周前来就诊。检查发现左下第一磨牙（牙合）面深龋洞，探诊洞底感酸痛，冷测反应一过性敏感，叩痛（-）。牙龈无异常。该患牙的诊断是可复性牙髓炎，作鉴别诊断时，最有价值的检查方法是温度测试，其处理方法是
A. 安抚治疗
B. 磷酸锌粘固粉垫底永久充填
C. 聚羧酸锌粘固粉垫底永久充填
D. 氧化锌丁香油粘固粉垫底永久充填
E. 直接永久充填

正确答案：A。安抚治疗

解析：本题考查可复性牙髓炎的治疗。可复性牙髓炎时牙髓处于充血状态，应进行安抚治疗（A对）,以缓解牙髓激惹症状，观察1～2周，复诊时牙髓充血恢复正常，再酌情作双层垫底永久充填或作间接盖髓术。在活髓牙中，磷酸锌粘固粉释放的游离酸会刺激牙髓，因此不能用磷酸锌粘固粉直接垫底永久充填（B错）。该病例中应该在安抚治疗确定牙髓恢复正常后，才可以用聚羧酸锌粘固粉垫底永久充填（C错）或氧化锌丁香油粘固粉垫底永久充填（D错）。该病例中牙髓充血症状明显，应先进行安抚治疗，直接永久充填会导致牙髓激惹症状加剧，进一步发展成为不可复性牙髓炎（E错）。